有关筛检的下列说法，哪个是正确的
A. 筛检试验的灵敏度是指一项筛检试验能将实际无病的人正确地判断为病人的能力。
B. 灵敏度与假阳性是互补的，特异度与假阴性是互补的。
C. 并联试验可以提高特异度，串联试验可以提高灵敏度。
D. 一般地说灵敏度高的试验阴性预测值高，特异度高的试验阳性预测值高。
E. 灵敏度和特异度是互补的。

正确答案：D。一般地说灵敏度高的试验阴性预测值高，特异度高的试验阳性预测值高。

解析：本题考查筛检指标的相关内容。筛检试验的灵敏度是指一项筛检试验能将实际有病的人正确地判断为病人的能力（A错）；灵敏度与假阴性是互补的，特异度与假阳性是互补的（BE错）；并联试验可以提高灵敏度，串联试验可以提高特异度（C错）；一般地说灵敏度高的试验阴性预测值高，特异度高的试验阳性预测值高（D对）。